佝偻病方颅多见于
A. 3～6个月
B. 7～8个月
C. 6个月以后
D. 2岁以后
E. 3岁以后

正确答案：B。7～8个月

解析：本题考查维生素D缺乏性佝偻病的相关病征。维生素D缺乏性佝偻病因形成颅骨软化后，使病情仍在进展，颅骨软化消失。7～8月龄（B对ACDE错）婴儿伴随脑组织发育增快，可出现额骨和顶骨中心部分因骨样组织矿化不良而增生致额骨及顶骨双侧呈对称性隆起，或称“方颅”，重者可呈鞍状、十字状颅形；头围也较正常增大，前囟边软。